初产妇，26岁。妊娠39周，规律宫缩8小时，自然破膜5小时，宫口开大3cm，胎心率118次/分，胎心监护频繁出现晚期减速，该患者正确的处理措施是
A. 急查尿雌雄素/肌酐比值
B. 观察胎心变化，宫口开全阴道助产
C. 立即行剖宫术
D. 静脉滴注缩宫素，加速产程进展
E. 吸氧，严密观察产程进展

正确答案：C。立即行剖宫术

解析：青年初产妇，妊娠39周，规律宫缩8小时，自然破膜5小时，宫口开大3cm（宫口开全为10cm，提示宫口尚未开全），胎心率118次/分，胎心监护频繁出现晚期减速（急性胎儿窘迫缺氧早期，胎儿电子监护可晚期减速），应首先考虑为胎儿窘迫，因宫口尚未开全，正确的处理措施是立即行剖宫术（C对）。急查尿雌激素/肌酐比值（P152）（A错）主要用于估计胎盘功能。吸氧，严密观察产程进展（E错）和观察胎心变化，宫口开全阴道助产（B错），会耽搁手术最佳时机，危及胎儿生命。静脉滴注缩宫素，加速产程进展（D错）会加重胎儿窘迫。